下列关于问卷的信度和效度叙述正确的是
A. 信度不高，效度不一定不高
B. 信度高，效度也高
C. 效度不高，信度也不高
D. 效度高，信度也高

正确答案：D。效度高，信度也高

解析：本题考查问卷的信度和效度。信度和效度的关系是：1.不可信的测量一定是无效的。即信度不高，效度也不会高（A错）；2.可信的测量既可能有效，也可能无效。即信度高，效度不一定也高（B错）；3.无效的测量既可能是可信的，也可能是不可信的。即效度不高，信度可能高，也可能不高（C错）；4.有效的测量一定是可信的测量。即效度高，信度一定也高（D对）。